食品营养强化剂量必须以营养素供给量标准为依据，使人每日从食物中摄取强化剂的量应达到供给量标准的
A. 1/3～2/3
B. 1/3～1/2
C. 1/2～2/3
D. 1/4～1/3
E. 2/3～3/4

正确答案：C。1/2～2/3